对2型糖尿病表现为单纯餐后血糖高，空腹和餐前血糖水平不高者可首选的药品是
A. 二甲双胍
B. α-阿卡波糖
C. 罗格列酮
D. 尼莫地平
E. 碘塞罗宁

正确答案：B。α-阿卡波糖

解析：本题考查降糖药。对2型糖尿病表现为单纯餐后血糖高，空腹和餐前血糖水平不高者可首选的药品是α-阿卡波糖（B对）。二甲双胍（A错）是治疗2型肥胖型糖尿病患者的首选。罗格列酮（C错）在餐后血糖升高为主，伴餐前血糖轻度升高的情况下首选。尼莫地平（D错）用于降血压。碘塞罗宁（E错）用于治疗甲状腺功能减退。